第二信使cAMP的作用是激活
A. DNA酶
B. 磷酸化酶
C. 蛋白激酶
D. 腺苷酸环化酶
E. 磷酸二酯酶

正确答案：C。蛋白激酶